在现代家庭中儿童的变态反应性疾病发病率在不断上升，这可能与下列哪个因素有关
A. 蚊子
B. 臭虫
C. 尘螨
D. 蟑螂
E. 病毒

正确答案：C。尘螨

解析：本题考查与变态反应性疾病有关的因素。尘螨是螨虫的一种，在潮湿、阴暗、通风条件差的环境中易孽生。尘螨（C对ABDE错）是室内主要的生物性变态反应原，可通过空气传播进入人体，因反复接触而致敏，可引起过敏性哮喘、过敏性鼻炎，也可引起皮肤过敏等。